地方性氟中毒的预防主要是
A. 改水
B. 增加维生素C的摄入
C. 种植吸氟植物
D. 食物除氟
E. 治疗氟斑牙

正确答案：A。改水

解析：本题考查地方性氟中毒的预防。地方性氟中毒是由于一定地区的环境中氟元素过多，而致生活在该环境中的居民经饮水、食物和空气等途径长期摄入过量氟所引起的以氟骨症和氟斑牙为主要特征的一种慢性全身性疾病。地方性氟中毒的预防主要是改水（A对BCDE错），其主要措施有：①打低氟深井水：我国大部分干早地区浅层地下水氟含量高，而深层地下水氟含量低，适于饮用，符合防病要求；②引用低氟地面水：将病区附近低氟的江、河、湖和泉水等地面水引入病区作为水源；③收集降水：在缺水地区修建小型水库或水窖，蓄积天然降水。